关于维拉帕米的叙述，哪项错误
A. 可用于治疗心绞痛
B. 可用于治疗高血压
C. 可用于治疗阵发性室上性心动过速
D. 禁用于有传导阻滞的病人
E. 禁用于心房颤动的病人

正确答案：E。禁用于心房颤动的病人